目的脏腑分属中，白睛所属的是
A. 心
B. 肺
C. 肝
D. 肾
E. 脾

正确答案：B。肺

解析：《灵枢·大惑论》曰：“精之窠为眼，骨之精为瞳子，筋之精为黑眼，血之精为络，其窠气之精为白眼，肌肉之精为约束”。后世医家据此归纳了“五轮学说”：瞳仁属肾（D错），称为水轮；黑睛属肝（C错），称为风轮；两眦血络属心（A错），称为血轮；白睛属肺（B对），称为气轮；眼睑属脾（E错），称为肉轮。观察五轮的形色变化，可以诊察相应脏腑的病变。因此，望目不仅在望神中有重要意义，而且可以测知五脏的变化，甚至对某些疾病的诊断可起到“见微知著”的作用。